以下无法通过一次现况研究实现的是
A. 掌握目标群体中某疾病的发病率及其分布状态
B. 提供疾病的病因线索
C. 对疾病监测等资料的质量评价
D. 评价预防接种效果
E. 确定高危人群

正确答案：A。掌握目标群体中某疾病的发病率及其分布状态

解析：本题考查现况研究的特点。现况研究的特点有：1.现况研究一般在设计阶段不设对照组；2.现况研究的特定时间；3.现况研究在确定因果关系时受到限制；4.对研究对象固有的暴露因素可以作因果判断；5.现况研究用现在的暴露（特征）来替代或估计过去情况的条件；6.现况研究定期重复进行可以获得发病率资料。目标群体中某疾病的发病率及其分布状态（A错，为本题正确答案）不能通过一次现况研究获得。